全学年，脑力工作能力最低时为
A. 第一学期开始
B. 第一学期中段
C. 第一学期末（寒假前）
D. 第二学期中段
E. 第二学期末（暑假前）

正确答案：E。第二学期末（暑假前）